健脾消食丸除健脾、消食外，又能
A. 润肠通便
B. 杀虫止痛
C. 和胃，化滞
D. 行气，利水
E. 祛痰，通便

正确答案：C。和胃，化滞

解析：本题考查的是健脾消食丸的功能。健脾消食丸除健脾、消食外，又能和胃，化滞（C对）。健脾消食丸：【功能】健脾，和胃，消食，化滞。麻仁胶囊：【功能】润肠通便（A错）。雷公藤：【功效】祛风除湿，活血通络，消肿止痛，杀虫（B错）解毒。槟榔：【功效】杀虫，消积，行气，利水（D错），截疟。一捻金：【功能】消食导滞，祛痰通便（E错）。